血栓闭塞性脉管炎诊断要点中不包括
A. 多为有吸烟嗜好的青壮年男性
B. 有游走性浅静脉炎病史
C. 患肢有不同程度的缺血性症状
D. 多合并有高血压、高脂血症、糖尿病
E. 患肢足背动脉或胫后动脉搏动减弱或消失

正确答案：D。多合并有高血压、高脂血症、糖尿病

解析：血栓闭塞性脉管炎一般不合并有高血压、高脂血症、糖尿病（D错，为本题正确答案）等基础疾病，多合并有高血压、高脂血症、糖尿病等基础疾病为动脉硬化性闭塞症的临床特点。血栓闭塞性脉管炎多发于有吸烟嗜好的青壮年男性（A对），由于四肢中、小动静脉受累闭塞，可导致患肢远端有不同程度的缺血性症状（C对），足背动脉搏动减弱或消失（E对）。大约30%的病人小腿部位有游走性浅静脉炎病史（B对）。